占据整个上颌窦窦壁有膨胀性改变的是
A. 牙瘤
B. 骨化纤维瘤
C. 成釉细胞瘤
D. 根尖周囊肿
E. 中央性骨髓炎

正确答案：B。骨化纤维瘤

解析：本题考查骨化纤维瘤的影像学表现。占据整个上颌窦窦壁有膨胀性改变的是骨化纤维瘤（B对）。骨化纤维瘤：X线片多以高低密度混合表现为主，部分病变以低密度变化为主；病变中有不同程度钙化或骨化影，表现为点状或斑片状。肿瘤和周围正常组织之间分界清晰。下颌骨下缘密质骨可有膨胀，但完整性存在；上颌骨者可占据整个上颌窦，窦壁有膨胀性改变。